主要通过氧自由基途径，导致心肌细胞氧化应激损伤，破坏了细胞膜的完整性，产生心脏毒性的药物是
A. 多柔比星
B. 地高辛
C. 维拉帕米
D. 普罗帕酮
E. 胺碘酮

正确答案：A。多柔比星

解析：本题考查多柔比星。主要通过氧自由基途径，导致心肌细胞氧化应激损伤，破坏了细胞膜的完整性，产生心脏毒性的药物是多柔比星（A对）。多柔比星是直接抑制DNA合成的蒽醌药物，作用机制为分子嵌入到DNA的双链中形成稳定的复合物，影响DNA的功能，阻止DNA的复制和RNA的转录。这类药物的毒性主要为骨髓抑制和心脏毒性。原因可能是醌环被还原成半醌自由基，诱发了脂质过氧化反应，引起心肌损伤。地高辛（B错）是强心苷类抗心衰药，主要通过抑制心肌细胞膜上Na⁺，K⁺-ATP酶，发挥正性肌力作用，同时提高心脏、主动脉弓、颈动脉窦压力感受器的敏感性，作为心力衰竭的辅助用药，适用于心力衰竭伴有快速心室率的心房颤动。地高辛的治疗指数窄，轻微的血浆浓度变化就会引起严重不良反应，最多见的是室性早搏、室上性心动过速、房室传导阻滞和心电图的改变。维拉帕米（C错）为钙通道阻滞剂类抗心律失常药，口服维拉帕米较为安全，静脉给药可引起血压下降和暂时窦性停搏。因维拉帕米具有负性肌力作用，在心室功能受损的患者中可促发充血性心力衰竭。普罗帕酮（D错）为钠通道阻滞剂类抗心律失常药，其不良反应常见于眩晕、头痛、运动失调、口腔金属异味、可使充血性心力衰竭恶化，此外还可致狼疮样面部皮疹和一种发疹性脓疱病。胺碘酮（E错）可引起肺毒性（发生率15%～20%），起病隐匿，最短见于用药后1周，多在连续应用3～12个月后出现。此外，胺碘酮服药者常发生显著的光过敏（20%），最终一些患者日光暴露皮肤呈蓝-灰色变（＜10%），严重影响美观。患者避免日晒或使用防晒用品，可减轻症状。